确定对某传染病接触者留验、检疫或医学观察期限，主要依据该传染病的
A. 潜伏期
B. 传染期
C. 病原携带期
D. 恢复期
E. 临床症状期

正确答案：A。潜伏期

解析：潜伏期（A对）为从病原体侵入人体起，至开始出现临床症状为止的时期。传染病病种的潜伏期不尽相同，检疫工作可通过结合潜伏期确定留观人群、时间等具体情况，以免漏检。